情绪是与何种需要相联系的
A. 生理需要
B. 交际需要
C. 认知需要
D. 安全需要
E. 自我实现需要

正确答案：A。生理需要

解析：情绪是个体受到情景刺激时，经过是否符合自己需要的判断后而产生的行为变化、生理变化和对事物态度的主观体验。掌握“情绪过程”知识点。